下面对RPD基托伸展范围的叙述哪项不对
A. 尽量缩小基托范围
B. 上颌后牙游离端后缘伸展到翼上颌切迹
C. 上颌后缘远中颊侧盖过上颌结节
D. 边缘伸入组织倒凹区
E. 下颌后缘覆盖磨牙后垫1/2～2/3

正确答案：D。边缘伸入组织倒凹区

解析：本题考查RPD的基托伸展范围。RPD（可摘局部义齿）基托的伸展范围根据缺牙部位、数目等具体情况有所不同，缺牙区基托不应进入组织倒凹区（D错，为本题的正确答案）。RPD包括牙支持式、黏膜支持式、混合支持式，当牙支持时应尽量缩小基托范围（A对），使患者感到轻巧、舒适、美观。混合支持的游离端义齿，在不影响唇、颊、舌软组织活动的原则下，基托范围应尽量伸展以分散（牙合）力、争取尽可能大范围的基托下黏膜组织支持，如：上颌后牙游离端后缘伸展到翼上颌切迹（B对）、上颌后缘远中颊侧盖过上颌结节（C对）、下颌后缘覆盖磨牙后垫1/3～1/2（E对），这样既不影响翼上颌切迹、上颌结节和磨牙后垫的正常生理功能，还可有效扩大基托面积，达到分散（牙合）力、保护软组织的目的。